体内脂肪大量动员时，肝内生成的乙酰辅酶A可生成
A. 葡萄糖
B. 二氧化碳和水
C. 胆固醇
D. 草酰乙酸
E. 酮体

正确答案：E。酮体